45岁以上男性，吸烟，同时患有糖尿病、高血压、血脂异常，常规服用阿司匹林预防心肌梗死，属于
A. 第一级预防
B. 第二级预防
C. 第三级预防
D. 根本预防
E. 三早预防

正确答案：A。第一级预防